感冒清热颗粒既能疏风解表，又能
A. 疏风解表
B. 解表清热
C. 宣肺止咳
D. 益气解表
E. 解肌清热

正确答案：B。解表清热

解析：本题考查的是感冒清热颗粒的功能。感冒清热颗粒既能疏风解表，又能解表清热（B对）。感冒清热颗粒：【功能】疏风散寒，解表（A错）清热。桑菊感冒片：【功能】疏风清热，宣肺止咳（C错）。参苏丸：【功能】益气解表（D错），疏风散寒，祛痰止咳。葛根芩连丸：【功能】解肌透表，清热（E错）解毒，利湿止泻。